关于普萘洛尔的叙述，哪项正确
A. 口服难吸收，生物利用度低
B. 选择性阻断β₁受体
C. 有内在拟交感活性
D. 可用于哮喘病患者
E. 对β₁、β₂受体无选择性

正确答案：E。对β₁、β₂受体无选择性